香薷散的功用是
A. 祛暑解表、化湿和中
B. 祛暑解表、清热化湿
C. 清暑解热、化气利湿
D. 清暑化湿、理气和中
E. 祛暑化湿、健脾和中

正确答案：A。祛暑解表、化湿和中

解析：香薷散中香薷辛微温，芳香质轻，辛温发散，为夏月祛暑解表要药。厚朴苦辛性温，行气除满，燥湿运脾。白扁豆甘淡性平，健脾和中，渗湿消暑。诸药合用，祛暑解表，化湿和中（A对），有表里双解之功。